男，25岁，持续发热10天，开始为38℃左右，5天后持续高热39～40℃，伴腹胀和轻度腹泻。体检：体温40℃，呼吸26次/分，脉搏86次/分，精神淡漠。两肺无异常。心率86次/分，律齐，第一心音偏低。腹胀无压痛，肝右肋下2cm，质软，脾左肋下1cm。血白细胞3.0×10⁹/L，中性75%，嗜酸粒细胞0.9%，单核5%，淋巴20%。最可能的诊断是
A. 菌痢
B. 伤寒、副伤寒
C. 结缔组织病
D. 结核病
E. 风湿热

正确答案：B。伤寒、副伤寒

解析：25岁男性患者，持续发热10天，开始为38℃左右，5天后持续高热39～40℃，伴腹胀和轻度腹泻（伤寒初期发热特点），体检：体温40℃，呼吸26次/分，脉搏86次/分，精神淡漠（伤寒面容），两肺无异常。心率86次/分，律齐，第一心音偏低，腹胀无压痛，肝右肋下2cm，软，脾左肋下lcm（肝脾肿大），血白细胞3.0×10⁹/LL（成人正常参考值4～10×10⁹/L），中性75%，嗜酸粒细胞0.9%（嗜酸粒细胞正常百分数0.5%～5%），单核5%，淋巴20%，根据患者的临床表现和实验室检查，最可能的诊断是伤寒（B对）。菌痢（P178）（A错）主要表现为腹痛、腹泻、排黏液脓血便以及里急后重等，可伴有发热和全身毒血症状，且无肝脾肿大，血白细胞和中性粒细胞都是增高的。结缔组织病（C错）结缔组织病多系统受累（即皮肤、关节、肌肉、心、肾、造血系统、中枢神经等可同时受累），病程长，病情复杂，可伴发热、关节痛、血管炎、血沉增快、γ球蛋白增高等，无相对缓脉和白细胞减少。结核病（D错）侵入不同部位表现不一，多在午后体温升高，一般为37～38℃之间，患者常伴有全身乏力或消瘦，夜间盗汗，女性可导致月经不调或停经，无相对缓脉，且血象分类中以单核升高为主（P212）。风湿热（E错）以多发性、大关节、游走性关节炎为典型特征，无相对缓脉和肝脾肿大，且心率多不齐，可有心脏杂音（八版内科学P804）。